作为医学伦理学基本范畴的情感是指
A. 医学关系中的主体在道义上应享有的权利和利益
B. 医学关系中的主体在道义上应履行的职责和使命
C. 医学关系的主体对应尽义务的自我认知和自我评价的能力
D. 医学关系中的主体因履行道德职责受到褒奖而产生的自我赞赏
E. 医学关系中的主体在医疗活动中对自己和他人关系的内心体验和感受

正确答案：E。医学关系中的主体在医疗活动中对自己和他人关系的内心体验和感受

解析：作为医学伦理学基本范畴的情感是指医务人员在医疗活动中所产生的职业道德情感，即对医德生活的内心体验、态度及其自然流露，即医学关系中的主体在医疗活动中对自己和他人关系的内心体验和感受（E对）。